地球化学性疾病的病因是
A. 严重环境污染引起的地区性化学成分改变超出了人体的适应能力
B. 地质化学条件的区域性差异超出人体的适应能力
C. 某种化学元素明显摄入不足
D. 某种化学元素明显摄入过多
E. 以上都不是

正确答案：B。地质化学条件的区域性差异超出人体的适应能力

解析：本题考查生物地球化学性疾病的病因。生物地球化学性疾病是由于地壳表面化学元素分布的不均匀性，使某些地区的水和（或）土壤中某些元素过多或过少，当地居民通过饮水、食物等途径摄入这些元素过多或过少，而引起某些特异性疾病。其病因是地质化学条件的区域性差异超出人体的适应能力（B对ACDE错）。